舌腹黏膜下层在舌腹三角区内有血管及神经走行，从外向内排列着
A. 舌神经、舌深静脉、舌深动脉
B. 舌神经、舌深动脉、舌深静脉
C. 舌深静脉、舌神经、舌深动脉
D. 舌深静脉、舌深动脉、舌神经
E. 舌深动脉、舌神经、舌深静脉

正确答案：C。舌深静脉、舌神经、舌深动脉

解析：舌腹黏膜下层在舌腹三角区内有血管及神经走行，从外向内排列着舌深静脉、舌神经和舌深动脉，还有黏液腺。掌握“腭、舌、舌下区的局部解剖”知识点。